下列关于火热内生形成机理的叙述，错误的是
A. 气有余便是火
B. 邪郁化火
C. 五志过极化火
D. 精亏血少，阴虚阳亢
E. 外感暑热阳邪

正确答案：E。外感暑热阳邪

解析：本题考查火热内生形成机理，属理解记忆内容。火热内生有虚实之分，其病机主要有如下几方面：1.阳气过盛化（A对）、2.火邪郁化火（B对）、3.五志过极化火（C对）、4阴虚火旺（D对）。外感暑热阳邪属于外感六淫邪气，不属于火热内生形成的机理（E错，为本题正确答案）。